女性，72岁，摔倒后左髋疼痛伴不能活动3小时，查体见左下肢缩短，外旋畸形，X线显示左侧股骨头下骨皮质不连续，断端部分吻合，外旋畸形常见的角度
A. 40~50
B. 80-90
C. 50-60
D. 20-30
E. 30-40

正确答案：C。50-60

解析：老年患者，有摔伤史，左下肢缩短、外旋畸形，考虑其最可能的诊断是左股骨颈骨折。股骨颈骨折的典型畸形是患肢缩短、轻度外旋（一般在45°～60°）（C对ABDE错）。